低血钾引起酸碱失衡的特点是
A. 血浆pH下降，血浆H+升高，细胞内H+升高，尿液H+升高
B. 血浆pH下降，血浆H+升高，细胞内H+下降，尿液H+下降
C. 血浆pH升高，血浆H+下降，细胞内H+下降，尿液H+下降
D. 血浆pH升高，血浆H+下降，细胞内H+升高，尿液H+升高
E. 血浆pH下降，血浆H+升高，细胞内H+升高，尿液H+下降

正确答案：D。血浆pH升高，血浆H+下降，细胞内H+升高，尿液H+升高

解析：发生低钾血症时引起细胞外的H+向细胞内移动，导致血浆H+下降，血浆pH升高，由于肾小管上皮细胞内缺钾，K+ -Na+交换减少，代之H+-Na+ 交换增多，H+排出增多，尿液尿液H+升高，所以低血钾引起酸碱失衡的特点是血浆pH升高，血浆H+下降，细胞内H+升高，尿液H+升高（D对）。